激动心肌β受体的抗心衰药是
A. 呋塞米
B. 地高辛
C. 依那普利
D. 米力农
E. 多巴酚丁胺

正确答案：E。多巴酚丁胺

解析：本题考查抗慢性心功能不全药。多巴酚丁胺（E对）主要激动β₁受体，增强心肌收缩力，增加心排血量；增加中、轻度CHF患者休息时的心排血量及血压，能缓解症状。呋塞米（A错）为利尿药。地高辛（B错）为强心苷类药物。依那普利（C错）为血管紧张素转换酶抑制药。米力农（D错）为非强心苷类正性肌力药。